由成釉细胞，外釉上皮，中间层和星网状层细胞构的、覆盖在釉小皮上的鳞状上皮，称为
A. 缩余釉上皮
B. 马拉瑟上皮剩余
C. 上皮根鞘
D. 上皮隔
E. 内釉上皮

正确答案：A。缩余釉上皮

解析：釉质发育完成后，成釉细胞，中间层细胞和星网状层与外釉上皮细胞结合，形成一层鳞状上皮覆盖在釉小皮上，称为缩余釉上皮。掌握“牙体、牙周组织的形成”知识点。